患儿8岁，8月12日清晨来院急诊。其母代诉：于昨夜突然起病，畏寒、高热、头痛、呕吐。甚至天亮前呼之不应，并持续抽搐。检查：患儿昏迷，高热41℃，瞳孔左＞右。呼吸节律不齐，呈双吸气。血象：白细胞28.4×10⁹/L，中性粒细胞0.94。本例的诊断最大的可能是
A. 流行性乙型脑炎
B. 暴发型流行性脑脊髓膜炎
C. 脑型疟疾
D. 中毒性细菌性痢疾
E. 金黄色葡萄球菌败血症

正确答案：A。流行性乙型脑炎